妇女“五期”的劳动保护是指
A. 青春期、经期、孕期、围产期和哺乳期
B. 经期、孕期、围产期、产后期和更年期
C. 青春期、经期、孕期、哺乳期和更年期
D. 青春期、孕期、围产期、产后期和哺乳期
E. 经期、孕期、围产期、哺乳期和更年期

正确答案：E。经期、孕期、围产期、哺乳期和更年期